乳剂属于热力学不稳定体系，在放置过程中可能出现的不稳定现象有
A. 分层
B. 絮凝
C. 转相
D. 合并
E. 酸败

正确答案：A、B、C、D、E。分层；絮凝；转相；合并；酸败

解析：本题考查乳剂。乳剂属于热力学不稳定的非均相分散体系。乳剂常发生下列变化：1.分层（A对）。乳剂的分层系指乳剂放置后出现分散相粒子上浮或下沉的现象，又称乳析。2.絮凝（B对）。乳剂中分散相的乳滴发生可逆的聚集现象称为絮凝。3.转相（C对）。由于某些条件的变化而改变乳剂的类型称为转相，由O/W型转变为W/O型或由W/O型转变为O/W型。4.合并（D对）与破裂。乳化膜破裂导致乳滴变大称为合并。合并进一步发展使乳剂分为油、水两相称为破裂。5.酸败（E对）。乳剂受外界因素及微生物的影响，使油相或乳化剂等发生变化而引起变质的现象称为酸败。